可摘局部义齿在修复义齿时，牙槽骨吸收不超过根长的
A. 0.5
B. 0.33333333333333
C. 0.66666666666667
D. 0.25
E. 0.75

正确答案：A。0.5

解析：有牙周病的牙列缺损者，可摘局部义齿在修复缺失牙的同时可兼作固定松动牙的牙周夹板。可摘局部义齿修复，基牙要求牙槽骨吸收不超过根长的1/2，松动二度者，应适当增加基牙数。固定义齿修复，基牙要求牙槽骨吸收不超过根长1/3，特殊病例可放宽至1/2。